磷酸吡哆醛作为辅酶参与的反应是
A. 转氨基反应
B. 酰基化反应
C. 转甲基反应
D. 过氧化反应
E. 磷酸化反应

正确答案：A。转氨基反应

解析：磷酸吡哆醛作为辅酶参与的反应是转氨基反应（A对），参与酰基化反应（B错）的辅酶是辅酶A，参与转甲基反应（C错）的辅酶是维生素B₁₂，参与过氧化反应（D错）的辅酶是NAD⁺、NADP⁺、FMN、FAD。